下列抗菌药物中，可作为耐青霉素肺炎链球菌肺炎治疗首选的是
A. 阿奇霉素
B. 头孢曲松
C. 阿米卡星
D. 阿莫西林
E. 头孢呋辛

正确答案：B。头孢曲松

解析：肺炎链球菌肺炎是由肺炎链球菌（SP）或称肺炎球菌所引起的肺炎，肺炎链球菌为革兰染色阳性球菌。头孢曲松（B 对）抗菌谱与头孢噻肟钠相仿，肺炎球菌、链球菌及金黄色葡萄球菌对本品中度敏感。阿奇霉素（A错）属于大环内酯类抗生素，首选适用于军团菌肺炎、肺炎支原体肺炎。阿米卡星（C错）是氨基糖苷类抗生素，适用于革兰阴性杆菌和对青霉素耐药的金黄色葡萄球菌引起的感染。阿莫西林（D错）属于青霉素类抗生素，对耐青霉素肺炎链球菌肺炎治疗无效。头孢呋辛（E错）为第二代广谱半合成头孢菌素，适用于对该品敏感的产或不产内酰氨酶的病原菌所致的中重度感染下呼吸道感染，肺炎慢性支气管炎急性发作，急性支气管炎，肺脓肿和其他肺部感染。